洋金花属于
A. 蓼科
B. 木兰科
C. 芸香科
D. 茄科
E. 马兜铃科

正确答案：D。茄科

解析：本题考查的是洋金花的来源。洋金花属于茄科植物（D对）。洋金花：【来源】为茄科植物白花曼陀罗的干燥花。来源于蓼科（A错）的中药有大黄、虎杖、何首乌、蓼大青叶等。来源于木兰科（B错）的中药有厚朴、辛夷、五味子、南五味子等。来源于芸香科（C错）的中药有黄柏、关黄柏、白鲜皮、枳壳、吴茱萸等。来源于马兜铃科（E错）的中药有马兜铃、细辛等。